脏腑湿热证的共同临床表现是
A. 黄疸
B. 腹痛
C. 腹泻
D. 舌苔黄腻
E. 头胀重

正确答案：D。舌苔黄腻

解析：湿热或痰热内蕴，阳气被遏，湿浊痰饮停聚舌面，则苔黄而质腻（D对）。黄疸（A错）是由于湿阻中焦，脾胃运化功能失常，肝胆的疏泄受到影响，所以胆汁不循常道，溢于肌肤而发。腹痛（B错）以脏腑气机不利，脏腑失养，经脉气血阻滞，不通则痛为基本病机。腹泻（C错），病多因感受外邪，如湿热、暑湿、寒湿之邪；或为情志所伤，忧思郁怒导致肝失疏泄，横逆犯脾而成泄泻；或饮食不节，过食油腻辛辣，或进食腐败污染之物等引起。头目胀重（E错），则多因肝火上炎或肝阳上亢，气血上壅于头目所致。